心理健康不包括
A. 智力正常
B. 健康行为
C. 情绪乐观
D. 意识清晰
E. 人格健全

正确答案：D。意识清晰

解析：我国的心理健康的标准包括智力正常、情绪良好、人际和谐、适应环境、人格完整（D错，为本题正确选项）。智力正常（A对）包括分布在智力正态分布曲线之内者以及能对日常生活作出正常反应的智力超常者。情绪良好（C对）包括能够经常保持愉快、开朗、自信的心情，善于从生活中寻求乐趣，对生活充满希望。一旦有了负性情绪，能够并善于调整，具有情绪的稳定性。人际和谐包括乐于与人交往，既有稳定而广泛的人际关系，又有知己的朋友：在交往中保持独立而完整的人格，有自知之明，不卑不亢：能客观评价别人，取人之长补己之短，宽以待人，乐于助人等。适应环境包括有积极的处世态度，与社会广泛接触，对社会现状有较清晰正确的认识，具有顺应社会改革变化的能力，勇于改造现实环境，达到自我实现与社会奉献的协调统一。心理健康的最终目标是培养健全的人格（E对），包括人格的各个结构要素不存在明显的缺陷与偏差，具有清醒的自我意识、不产生自我同一性混乱，以积极进取的人生观作为人格的核心，有相对完整的心理特征等。健康行为（B对）也是心理健康的标准。